釉质形成缺陷症的遗传类型中表现为X染色体相关型的病因是
A. 成釉蛋白基因突变
B. 釉蛋白基因突变
C. 釉丛蛋白基因突变
D. 编码釉原蛋白的AMELX基因突变
E. 以上均不正确

正确答案：D。编码釉原蛋白的AMELX基因突变

解析：釉质形成缺陷症的遗传类型最常见为常染色体显性型，主要与成釉蛋白、釉蛋白、釉丛蛋白的编码基因突变相关；较少见为X染色体相关型，主要与编码釉原蛋白的X染色体上的AMELX基因突变相关。掌握“釉质形成缺陷（釉质发育不全）”知识点。